溶血性黄疸主要特点是
A. 尿胆红素阳性
B. 尿胆原阴性
C. 血中结合胆红素增高
D. 血中非结合胆红素增高
E. 血中两种胆红素均增高

正确答案：D。血中非结合胆红素增高

解析：溶血性黄疸的发生机制：由于大量红细胞破坏，使非结合胆红素生成增多，超出了肝细胞摄取、转化与排泄能力，导致非结合胆红素潴留。同时，肝细胞转化形成的结合胆红素增多，排入肠道的结合胆红素增加，从而尿胆原增多、尿胆红素为阴性、血中结合胆红素不会增高（D对）。